不属于人工被动免疫的方式是
A. 注射人血清丙种球蛋白
B. 注射含特异性抗体的球蛋白
C. 注射免疫核糖核酸
D. 注射胸腺素
E. 通过胎盘从母体获得抗体

正确答案：E。通过胎盘从母体获得抗体